阿托品的药理作用是
A. 减少腺体分泌
B. 升高血压
C. 促进肠蠕动
D. 抑制中枢
E. 收缩支气管

正确答案：A。减少腺体分泌

解析：本题考查阿托品。阿托品为乙酰胆碱M受体阻断剂，能够抑制腺体分泌（A对）、扩瞳、解除血管痉挛，使血压下降（B错）、还可舒张内脏平滑肌，抑制胃肠蠕动（C错）；阿托品小剂量时兴奋中枢，大剂量时抑制中枢（D错）；阿托品不能收缩支气管（E错）。